子宫动脉发自
A. 髂外动脉
B. 髂内动脉
C. 闭孔动脉
D. 臀上动脉
E. 阴部内动脉

正确答案：B。髂内动脉

解析：子宫动脉发自髂内动脉（B对），子宫动脉发出分支营养子宫、卵巢、输卵管和阴道，并与卵巢动脉吻合。